不合理用药的后果是
A. 浪费医药资源
B. 引发药源性疾病
C. 延误疾病治疗
D. 引发药物不良反应
E. 造成医疗纠纷

正确答案：A、B、C、D、E。浪费医药资源；引发药源性疾病；延误疾病治疗；引发药物不良反应；造成医疗纠纷

解析：本题考查的是不合理用药的后果。不合理用药的后果是浪费医药资源（A对）、引发药源性疾病（B对）、延误疾病治疗（C对）、引发药物不良反应（D对）与造成医疗纠纷（E对）。不合理用药的后果：1.浪费医药资源。2.延误疾病的治疗。3.引发药物不良反应及药源性疾病的发生。4.造成医疗事故和医疗纠纷。